医疗机构配制制剂应取得的合法证件是
A. 药品注册商标
B. 药品批准文号
C. 《药品生产许可证》
D. 《药品经营许可证》
E. 《医疗机构制剂许可证》

正确答案：E。《医疗机构制剂许可证》

解析：医疗机构制剂的申请人，应当是持有《医疗机构执业许可证》、有相应诊疗科目，并取得《医疗机构制剂许可证》的医疗机构。未取得《医疗机构制剂许可证》或者《医疗机构制剂许可证》无相应制剂剂型的"医院"类别的医疗机构可以申请医疗机构中药制剂，但是必须同时提出委托配制制剂的申请（E对）。药品注册商标是为了保证药品质量，保障人民身体健康，维护药品生产企业和药品经营企业的正当利益，根据《药品管理法》和《商标法》的规定，除中药材、中药饮片外，药品必须使用注册商标；未经核准注册的，不得在市场销售（A错）。生产新药或者已有国家标准的药品的，须经国务院药品监督管理部门批准，并在批准文件上规定该药品的专有编号，此编号称为药品批准文号（B错）。《药品生产许可证》用于药品生产企业（C错）。《药品管理法》规定，无《药品经营许可证》的，不得经营药品（D错）。